微粒给药系统通过吞噬作用进入细胞的过程属于
A. 滤过
B. 简单扩散
C. 主动转运
D. 易化扩散
E. 膜动转运

正确答案：E。膜动转运

解析：本题考查药物的转运方式。膜动转运（E对）是生物膜通过主动变形，膜凹陷吞没将某些物质摄入细胞内或从细胞内释放到细胞外的过程，摄取的是微粒或大分子物质称为吞噬；滤过（A错）是指水溶性分子借助于流体静压或渗透压随体液通过细胞膜的水性通道而进行的跨膜转运；简单扩散（B错）是药物分子顺浓度梯度通过生物膜；主动转运（C错）是借助生物膜载体，逆浓度梯度的转运；易化扩散（D错）为借助载体的被动转运。